初产妇开始保护会阴的时机是
A. 宫口开全后阴道口见胎头时
B. 胎头拨露使阴唇后联合紧张时
C. 胎头着冠时
D. 胎头开始仰伸时
E. 胎肩娩出前后

正确答案：B。胎头拨露使阴唇后联合紧张时

解析：宫缩时胎头露出于阴道口，露出部分不断增大，宫缩间歇期，胎头又缩回阴道内，称为胎头拨露。当胎头双顶径越过骨盆出口，宫缩间歇时胎头不再回缩，称为胎头着冠初产妇开始保护会阴的时机是胎头拨露使阴唇后联合紧张时（B对）。胎头着冠时（C错）、胎头开始仰伸时（D错）晚于胎头拨露时间，因此，胎头着冠、胎头开始仰伸不是初产妇开始保护会阴的时机。宫口开全后阴道口见胎头时（A错）是将初产妇送至分娩室，做好接产准备工作的时机。胎肩娩出后保护会阴的手可放松（E错）。